患者心悸，气短，劳则尤甚，神疲体倦，自汗。治疗应首选
A. 补肺汤
B. 七福饮
C. 加味四君子汤
D. 大补元煎
E. 金匮肾气丸

正确答案：B。七福饮

解析：补肺汤为虚劳肺气虚证的选方，功能补益肺气，肃肺止咳（A错）。题中患者以心悸，气短为主症，无善惊易恐，不寐多梦而易惊醒的症状，故诊断为虚劳而非心悸。心悸，气短，神疲体倦为心气不足，鼓动无力，心失所养而致，劳则耗气，故劳则尤甚，心气不足，卫阳不固，故自汗，辨为心气虚证，治宜益气养心，方选七福饮（B对）。加味四君子汤为虚劳脾气虚证的选方，功能益气健脾除湿（C错）。大补元煎为虚劳肾气虚证的选方，功能补益肾气（D错）。金匮肾气丸功能补肾助阳，主治肾阳不足证（E错）。